对于无器质性心脏病无症状的室性期前收缩的患者，应釆取的治疗是
A. 去除病因和诱因
B. 胺碘酮
C. 维拉帕米
D. 普罗帕酮
E. 美西律

正确答案：A。去除病因和诱因

解析：室性期前收缩是一种最常见的心律失常，正常人与各种心脏病患者均可发生，正常人发生室性期前收缩的机会随年龄的增长而增加。常见于高血压、冠心病、心肌病、风湿性心肌病与二尖瓣脱垂患者。对于无器质性心脏病无症状的室性期前收缩的患者，不必使用药物治疗，釆取去除病因和诱因（A对）的治疗即可。如患者症状明显，治疗以消除症状为目的，药物宜选用β受体拮抗剂、普罗帕酮（D错）、美西律（E错）、莫雷西嗪等。对于有慢性心脏病的室性期前收缩患者，应当避免应用Ⅰ类药物，β受体拮抗剂对室性期前收缩的疗效不显著，但能降低心肌梗死后猝死发生率、再梗死率和总病死率，此时若频发多源性室早，可首选胺碘酮（B错）治疗。维拉帕米（P206）（C错）为非二氢吡啶类钙通道拮抗剂，主要适用于各种室上性心动过速，房室折返性心动过速等。